关于青少年牙周炎的叙述，以下哪项是错误的
A. 主要发生在青春期至25岁的年轻人，女性多于男性
B. 早期患者菌斑、牙石很少、牙周组织破坏程度与局部刺激物的量不成正比
C. X线显示第一磨牙近远中成水平吸收，切牙区多呈弧形吸收
D. 病程进展很快
E. 可能有家族遗传史

正确答案：C。X线显示第一磨牙近远中成水平吸收，切牙区多呈弧形吸收

解析：本题考查局限侵袭性牙周炎。第一磨牙近远中牙槽骨发生垂直性吸收，切牙牙槽嵴牙槽间隔窄，一般表现水平型骨吸收，故X线显示第一磨牙近远中弧形吸收，切牙区多呈成水平吸收（C错，为本题的正确答案）。青少年牙周炎又称局限侵袭性牙周炎，发病年龄较早，主要发生在青春期至25岁的年轻人，女性多于男性（A对）。早期患者菌斑、牙石很少、牙龈表面的炎症轻微、牙周组织破坏程度与局部刺激物的量不成正比（B对），牙周破坏程度很重，牙石菌斑量很少。病程进展很快（D对），牙周破坏程度比慢性牙周炎快3～4倍，患者常在20岁左右即已需拔牙或自行脱落。可能有家族遗传史，家族中常有多代、多人患本病（E对）。